颈总动脉分为颈内动脉和颈外动脉的部位是
A. 平胸锁关节处
B. 平甲状软骨上缘
C. 平甲状软骨下缘
D. 平舌骨大角尖
E. 平下颌角处

正确答案：B。平甲状软骨上缘

解析：面颈部的血液供应主要来自颈总动脉和锁骨下动脉。颈总动脉在约平甲状软骨上缘处分为颈内动脉和颈外动脉。掌握“颈内外动脉主要分支及分布”知识点。